应激时铜蓝蛋白的增加
A. 增强抗出血能力
B. 增强抗感染能力
C. 两者均可
D. 两者均否
E. 无

正确答案：D。两者均否

解析：应激时铜蓝蛋白的增加，可促进氧自由基的清除，但增强抗出血能力和增强抗感染能力两者均否（D对）。